关于药物警戒与药物不良反应监测的说法，正确的是
A. 药物警戒是药物不良反应监测的一项主要工作
B. 药物不良反应监测对象包括质量不合格的药品
C. 药物警戒的对象包括药物与其它化合物，药物与食物的相互作用
D. 药物警戒工作限于药物不良反应监测与报告之外的其它不良信息的收集与分析
E. 药物不良反应监测的工作内容包括用药失误的评价

正确答案：C。药物警戒的对象包括药物与其它化合物，药物与食物的相互作用

解析：本题考查药物警戒与药物不良反应监测。药物警戒监测的对象有除质量合格药品之外的其他药品，如低于法定标准的药品、药物与其它化合物，药物与食物的相互作用（C对）等。药物警戒工作包括药品不良反应监测工作以及其它工作，例如用药失误、缺乏疗效的报告等，所以药物警戒不是药物不良反应监测的一项主要工作（A错），即药物警戒包括药物不良反应监测，而不是药物不良反应监测包括药物警戒，这个要区分清楚。药物不良反应监测的对象和药物警戒监测的对象不一样，药物不良反应监测对象不包括质量不合格的药品（B错），其对象是质量合格的药品。药物警戒工作不限于药物不良反应监测与报告之外的其它不良信息的收集与分析（D错）。药物不良反应监测的工作内容不包括用药失误的评价（E错），药品不良反应监测是指药品不良反应的发现、报告、评价和控制的过程。药物警戒包括用药失误的评价。